青霉素的特点是
A. 高效，低毒
B. 对螺旋体感染也有效
C. 不耐酸，不能口服
D. 不耐酸，不耐酶
E. 耐酸，不易水解

正确答案：A、B、C、D。高效，低毒；对螺旋体感染也有效；不耐酸，不能口服；不耐酸，不耐酶

解析：本题考查青霉素的特点。青霉素干扰敏感细菌细胞壁黏肽合成，对于处于繁殖期细菌作用强，对人类毒性小（A对）。青霉素对螺旋体和放线菌也有效（B对）。在酸性或碱性条件下，均可使青霉素的β-内酰胺环发生裂解（C对E错）。不耐青霉素酶（D对）。